四物汤主治证候的病因病机是
A. 气衰血少
B. 劳倦内伤
C. 冲任虚损
D. 郁怒伤肝
E. 阴精亏虚

正确答案：C。冲任虚损

解析：四物汤主治营血虚损证，由营血亏虚，血行不畅，冲任虚损所致。（C对）。